当温度上升到一定程度时，溶解度急剧下降并析出，溶液出现混浊，这一温度称为
A. F值
B. HLB值
C. Krafft点
D. 昙点
E. F₀值

正确答案：D。昙点